根据苷键原子分类，苦杏仁苷属于
A. 硫苷
B. 氮苷
C. 碳苷
D. 酯苷
E. 氧苷

正确答案：E。氧苷

解析：本题考查氧苷分类。氧苷（E对）（O-苷）以苷元不同又可分为醇苷、酚苷、氰苷、酯苷和吲哚苷。苦杏仁苷是一种氰苷，易被酸和酶所催化水解。水解所得到的苷元α-羟基苯乙腈很不稳定，易分解生成苯甲醛和氢氰酸。其中苯甲醛具有特殊的香味。通常将此作为鉴别苦杏仁苷的方法。硫苷（A错）（S-苷）糖端基羟基与苷元上巯基缩合而成的苷称为硫苷。如萝卜中的萝卜苷，煮萝卜时的特殊气味与硫苷元的分解产物有关。氮苷（B错）（N-苷）通过氮原子与糖的端基碳相连的苷称为N-苷，苷元通常是嘌呤或嘧啶及其衍生物。另外，中药巴豆中的巴豆苷是与腺苷结构相似的N-苷。碳苷（C错）（C-苷）是一类糖基直接以C原子与苷元的C原子相连的苷类，由苷元酚基所活化的邻或对位氢与糖的端基羟基脱水缩合而成。芦荟苷是最早发现的结晶性蒽酮碳苷。酯苷（D错）苷元以羧基和糖的端基碳相连接。这种苷的苷键既有缩醛性质又有酯的性质，易被稀酸和稀碱所水解。如具抗真菌活性的山慈菇苷A。